乌须明目的药物是
A. 玉竹
B. 百合
C. 石斛
D. 北沙参
E. 女贞子

正确答案：E。女贞子

解析：以上选项皆为补阴药。女贞子甘、苦，凉；入肝、肾经。可治疗肝肾阴虚，眩晕耳鸣，腰膝酸软，须发早白，目暗不明（E对），内热消渴，骨蒸潮热。善滋补肝肾，又兼清虚热，补中有清。治肝肾阴虚所致的眩晕耳鸣，腰膝酸软，须发早白，目暗不明，内热消渴，骨蒸潮热，常与墨旱莲配伍。治疗阴虚有热，目微红羞明，眼珠作痛者，宜与生地黄、石决明、谷精草等滋阴清肝明目之品同用。治疗肾阴亏虚，内热消渴者，宜与生地、天冬、山药等滋阴补肾清热之品同用。若阴虚内热之潮热心烦者宜与生地、知母、地骨皮等养阴、清虚热之品同用。